女，14岁。月经周期紊乱，经期长短不一已有4月余。肛门检查：子宫发育正常，双侧附件（-）。最可能的诊断是
A. 黄体功能不全
B. 黄体萎缩不全
C. 无排卵性功能失调性子宫出血
D. 子宫内膜息肉
E. 子宫黏膜下肌瘤

正确答案：C。无排卵性功能失调性子宫出血

解析：女，14岁（无排卵性功血好发于青春期和绝经过渡期），月经周期紊乱，经期长短不一已有4月余（无排卵性功血最常见的症状表现为月经周期紊乱，经期长短不一），子宫发育正常，双侧附件（-）。结合患者的临床表现，可诊断为无排卵性功能失调性子宫出血（C对）。黄体功能不全（A错）多发生于生育年龄妇女，主要表现为月经周期缩短（P350）。黄体萎缩不全（B错）也多发生于生育年龄妇女，主要临床表现为月经周期正常，但经期延长，长达9～10天，且出血量多（P351）。子宫内膜息肉（D错）常见于35岁以上的妇女，有月经过多或不规则阴道流血常伴腹痛及白带异常，且子宫稍大于正常。子宫黏膜下肌瘤（E错）常见于30～50岁妇女，20岁以下少见，最常见的临床症状为经量增多及经期延长，妇科检查可扪及子宫增大，而不是正常（P312）。